佝偻病恢复期X线表现
A. 干骺端增厚，钙化预备带消失，呈毛刷样杯口状改变
B. 钙化预备带重新出现，致密增厚
C. 骨骼无明显改变
D. 长骨短曲和弯曲，干骺端变宽，呈喇叭口状，轮廓光整
E. 长骨钙化预备带密度增加，骨皮质增厚及骨硬化

正确答案：B。钙化预备带重新出现，致密增厚

解析：本题考查维生素D缺乏性佝偻病恢复期X线表现。本题考查维生素D缺乏性佝偻病恢复期在治疗2～3周后骨骼X线改变有所改善，重新出现不规则的钙化线，以后钙化带致密增厚（B对ACDE错），生长板＜2mm，逐渐恢复正常。